属特殊管理药品需专柜存放的药是
A. 血竭面
B. 牛黄
C. 罂粟壳
D. 阿魏
E. 龟甲

正确答案：C。罂粟壳

解析：本题考查的是斗谱排列时应参考的其他原则。属特殊管理药品需专柜存放的药是罂粟壳（C对）。罂粟壳属于麻醉中药，应按照有关规定存放。罂粟壳有成瘾性，故不宜常服，孕妇及儿童禁用，运动员慎用。罂粟壳必须凭有麻醉药处方权的执业医师签名的淡红色麻醉药处方方可调配，应于群药中，且与群药一起调配，不得单方发药，每张处方不得超过三日用量，连续使用不得超过7天，成人一次的常用量为每天3～6g。处方保存3年备查。斗谱排列时还应参考的其他原则：有些药物放在一起可能造成意外事故的发生，因此在摆放时应注意以下几点。（1）属于配伍禁忌的药物，不能装于一斗或上下药斗中。如甘草与京大戟、甘遂、芫花；藜芦与丹参、南沙参、玄参、苦参、白芍、赤芍、细辛；乌头类（附子、川乌及草乌）与半夏的各种炮制品、瓜蒌（瓜蒌皮、瓜蒌子、瓜蒌仁及天花粉）；丁香（包括母丁香）与郁金（黄郁金、黑郁金）；芒硝（包括玄明粉）与京三棱；肉桂（官桂）与石脂（赤石脂）均不宜放在一起。（2）外观性状相似的饮片，尤其是外观形状相似但功效不同的饮片，不宜排列在一起。如蒲黄与海金沙，紫苏子与菟丝子，山药与天花粉，杏仁与桃仁，厚朴与海桐皮，荆芥与紫苏叶，大蓟与小蓟，炙甘草与炙黄芪，当归与独活，制南星与象贝（浙贝），菟丝子与苏子，熟地与黄精，知母与玉竹，蛇床子与地肤子，玫瑰花与月季花，血余炭与干漆炭，韭菜子与葱子等。（3）药名相近，但性味功效不同的饮片不应排列在一起。如附子与白附子，藜芦与漏芦，天葵子与冬葵子等。（4）同一植物来源但不同部位入药的并且功效不相同的饮片不能排列在一起，如麻黄与麻黄根。（5）为防止灰尘污染，有些中药不宜放在一般的药斗内，而宜存放在加盖的瓷罐中，以保持清洁卫生。如熟地黄、龙眼肉、青黛、玄明粉、松花粉、生蒲黄、乳香面、没药面、儿茶面、血竭面（A错）等。（6）有恶劣气味的药物，不能与其他药物装于一个药斗中。如阿魏（D错）、鸡矢藤等。（7）贵细药品（价格昂贵或稀少的中药）不能存放在一般的药斗内，应设专柜存放，由专人管理，每天清点账物。如牛黄（B错）、麝香、西红花、人参、西洋参、羚羊角、鹿茸、珍珠、冬虫夏草、海龙、海马等。（8）毒性中药和麻醉中药应按照有关规定存放，绝不能放于一般药斗内，必须专柜、专锁、专账、专人管理，严防意外事故的发生。龟甲（E错）质地沉重，应放在斗架的较下层。质地沉重的矿石、化石、贝壳类药物和易于造成污染的药物（如炭药），多放在斗架的较下层。前者如磁石、赭石与紫石英，龙骨、龙齿与牡蛎，石决明、珍珠母与瓦楞子，石膏、寒水石与海蛤壳等。